神经-骨骼肌接头处的兴奋传递物质是
A. 去甲肾上腺素
B. 肾上腺素
C. 乙酰胆碱
D. 谷氨酸
E. 多巴胺

正确答案：C。乙酰胆碱

解析：骨骼肌神经-肌肉接头由接头前膜-接触间隙-接头后膜（终板膜）组成。动作电位传到运动神经末梢引起接头前膜去极化，电压门控钙通道开放，Ca²⁺进入神经末梢，引起突触囊泡出胞、ACh（乙酰胆碱）（C对）释放，继而激活突触后膜N₂型ACh受体阳离子通道，终板膜对Na⁺、K⁺等通透性增高，终板膜去极化，产生终板电位，完成由化学信号到电信号的转导。肾上腺素（B错）和去甲肾上腺素（A错）为为肾上腺素能神经元和去甲肾上腺素能神经元的递质，神经-骨骼肌接头处的神经元为胆碱能神经元，无此递质（P310）。谷氨酸（P311）（D错）是脑和脊髓内主要的兴奋性递质。多巴胺（P310）（E错）是一种脑内分泌物，主要存在于中枢，不参与神经-骨骼肌兴奋传递。